下列哪项不是细胞因子的生物学功能
A. 调节固有免疫应答
B. 调节适应性免疫应答
C. 刺激造血细胞生成
D. 细胞毒效应
E. 特异性结合抗原

正确答案：E。特异性结合抗原